3个月牛奶喂养婴儿因反复无热惊厥1天入院，实验室检查：血清钙1.75mmol/L，血清镁0.99mmol/L，血糖5.6mmol/L。下列措施应首选
A. 10%葡萄糖酸钙10ml稀释后静点
B. 50%葡萄糖2ml/（kg·d）静注
C. 25%硫酸镁0.2m/（kg·d）肌注
D. 维生素D330万IU肌注
E. 10%葡萄糖酸钙10ml静推

正确答案：A。10%葡萄糖酸钙10ml稀释后静点

解析：本题考查维生素D缺乏性佝偻病的预防与控制。维生素D缺乏性佝偻病早期：多见于6月龄内，特别是3月龄内的婴儿，可有多汗、易激惹、夜惊等非特异性神经精神症状，此期常无骨骼病变。血钙、血磷正常或稍低，碱性磷酸酶（AKP）正常或稍高，血25-（OH）D降低。骨X线片无异常或长骨干骺端临时钙化带模糊，此时该婴儿应该选择10%葡萄糖酸钙10ml稀释后静点（A对BCDE错）。